专卷收载民族药的药物专著是
A. 《普济方》
B. 《本草纲目》
C. 《太平圣惠方》
D. 《中华本草》
E. 《中国中药资源志要》

正确答案：D。《中华本草》

解析：本题考查的是《中华本草》。专卷收载民族药的药物专著是《中华本草》（D对）。《中华本草》：是由国家中医药管理局主持，南京中医药大学总编审，全国60多个单位500余名专家历时10年共同编纂，上海科学技术出版社出版的划时代巨著。全书共35卷。前30卷为中药，1999年9月出版，包括总论1卷，药物26卷，附编1卷，索引2卷。后5卷为民族药专卷，包括藏药、蒙药、维吾尔药、傣药、苗药各1卷。该书全面总结了中华民族两千余年来传统药学成就，集中反映了20世纪中药学科、藏药学科、蒙药学科、维吾尔药学科、傣药学科及苗药学科的发展水平，对中医药、藏医药、蒙医药、维吾尔医药、傣医药及苗医药的教学、科研、临床治疗、资源开发、新药研制等具有一定的指导作用和实用价值。《普济方》（A错）：明•朱橚等撰，公元1390年撰成，1406年刊行。原为168卷，后改为426卷，收方61739首，原有插图239幅，保存了大量的民间验方。是中国古代收方最多的方书，为研究复方用药提供了极为珍贵的资料。朱橚为医药学的发展做出了较大的贡献，使明初及其以前的医药资料得以保存。今有铅印本共十册，仅有文无图。十册铅印本是以《四库全书》版排印，共1960论，2175卷，778法，载方61739首。《本草纲目》（B错）：简称《纲目》，明·李时珍著，成书于1578年。此书可谓中药学巨著，内容广博，收罗繁富。全书引据历代本草凡84家，古今医书目277种，另从经史子集各部著作中引录了大量有关的文献资料，参考文献共计800余种。书中共收载药物1892种，方剂11096首，附有药物图谱1109幅。问世后被全部或部分译成日、朝、英、法、意、俄等多种文字。《太平圣惠方》（C错）：宋·王怀隐等编。全书共100卷，分1670门，收方16834首。该书以临床实用为目的，首详诊脉辨阴阳法，次叙处方用药法则，然后按科分叙各科病证和病因、病理以及方药的适应证和药物剂量。因证设方，药随方施，理法方药兼收并蓄。《中国中药资源志要》（E错）：由张洪魁主编，科学出版社1994年出版。该书是在全国中药资源普查基础上，参考各省市、自治区提供的中药资源名录及国内外有关文献和部分科研成果编撰而成。全书共收载了全国药用植物12964种，其中药用植物383科2313属11020种（含种下等级1208个），药用动物414科879属1590种，药用矿物84种，较为全面系统地总结了新中国成立以来中医药工作者对中药资源的研究成果。